对未用抗结核药的初治结核病者，其短程化疗方案疗程是
A. 2个月
B. 4个月
C. 6个月
D. 12个月
E. 18～24个月

正确答案：C。6个月

解析：本题考查结核病的治疗。对未用抗结核药的初治结核病者，其短程化疗方案疗程是6个月（C对）。初治方案：初治涂阳病例均可用以异烟肼（H）利福平（R）及吡嗪酰胺（Z）组合为基础的6个月短程化疗方案。